关于牙震荡治疗的顺序说法不正确的是
A. 受伤后1、3、6、12个月应进行定期复查
B. 牙冠不变色，牙髓活力测试正常需行根管治疗
C. 牙髓坏死的情况时，可以进行根管治疗术
D. 年轻恒牙牙髓活力可在受伤后1年后才丧失
E. 患牙在必要时应该降低咬合减轻负担

正确答案：B。牙冠不变色，牙髓活力测试正常需行根管治疗

解析：牙震荡的治疗原则：①1～2周内应使患牙休息，必要时降低咬合以减轻患牙的咬合力负担；②受伤后1、3、6、12个月应进行定期复查。观察1年后，若牙冠不变色，牙髓活力测试正常，可不进行处理；若有牙髓坏死迹象时，应进一步作根管治疗术。必须记住，在年轻恒牙，其活力可在受伤1年后才丧失。掌握“牙震荡”知识点。